最短潜伏期与最长潜伏期之间发病的人数占所有易感接触者总数的百分率指
A. 患病率
B. 病死率
C. 续发率
D. 死亡率
E. 感染率

正确答案：C。续发率

解析：续发率又称二代发病率，指某传染病易感接触者中，在最短潜伏期与最长潜伏期之间发病的人数占所有易感接触者总数的百分率。掌握“流行病学资料与疾病分布”知识点。